化脓性细菌侵入血流引起的症状称为
A. 败血症
B. 毒血症
C. 菌血症
D. 脓毒血症
E. 病毒血症

正确答案：D。脓毒血症